与气虚关系最密切的脏腑是
A. 心、肺
B. 肺、脾
C. 肺、肾
D. 脾、胃
E. 肝、肺

正确答案：B。肺、脾

解析：心与肺的关系主要体现在气与血、血液循环与呼吸运动的关系方面（A错）。肺与脾的关系主要体现在气的生成和水液代谢两方面。肺脾两脏常相互影响，肺气虚累及脾，脾气虚影响肺，终致肺脾气虚之候，与气虚的关系最密切（B对）。肺肾之间的关系主要表现为呼吸和水液代谢方面（C错）。脾胃的关系体现为水谷纳运相得、气机升降相因、阴阳燥湿象济等三个方面（D错）。肝与肺的关系主要表现在人体气机升降的调节方面（E错）。